归纳观察现象，解释疾病分布，提出病因假说
A. 描述流行病学
B. 分析流行病学
C. 实验流行病学
D. 理论流行病学
E. 血清流行病学

正确答案：A。描述流行病学